某公司秘书兼任打字员，长时间工作后，主诉头痛、眼干、眼痛、视物模糊等，此种表现属
A. 暂时性疲劳
B. 智力疲劳
C. 局部性疲劳
D. 全身性疲劳
E. 技术性疲劳

正确答案：C。局部性疲劳